以下不属于消化性溃疡手术治疗指证的是
A. 内科治疗无效
B. 常于夜间发作腹痛
C. 十二指肠溃疡合并幽门梗阻
D. 饱餐后胃溃疡穿孔
E. 胃巨大溃疡

正确答案：B。常于夜间发作腹痛

解析：夜间发作腹痛（B错，为本题正确答案）只是消化性溃疡的一个临床表现，需要仔细了解疾病的部位及严重程度再决定是否需要手术。消化性溃疡内科治疗无效（A对）应行手术，十二指肠溃疡瘢痕性幽门梗阻（C对）导致严重狭窄时，则需手术介入。饱餐后胃溃疡穿孔（P340）（D对）会导致大出血，会在短期内发生休克，应及时行穿孔缝合术。胃巨大溃疡（E对）应行胃大部切除术。